具有清心热、养心、安神、开窍的功能，用于热病攻心、神昏谵语的藏成药是
A. 五味麝香丸
B. 八味沉香散
C. 六味安消散
D. 七味红花殊胜丸
E. 十味黑冰片丸

正确答案：B。八味沉香散

解析：本题考查的是八味沉香散的功能与主治。具有清心热、养心、安神、开窍的功能，用于热病攻心、神昏谵语的藏成药是八味沉香散（B对）。八味沉香散的功能与主治：清心热，养心，安神，开窍。用于热病攻心，神昏谵语；冠心病，心绞痛。五味麝香丸（A错）的功能与主治：清热解毒，凉血消肿。用于血热毒盛，小儿疖疮，痱毒，咽喉肿痛，口舌生疮，牙龈出血，痄腮。六味安消散（C错）的功能与主治：和胃健脾，消积导滞，活血止痛。用于脾胃不和，积滞内停所致的胃痛胀满、消化不良、便秘、痛经。七味红花殊胜丸（D错）的功能与主治：清热消炎，保肝退黄。用于新旧肝病，巩膜黄染，食欲不振等。十味黑冰片丸（E错）的功能与主治：温胃消食，破积利胆。用于龙病，食积不化，恶心，培根痞瘤，胆囊炎，胆结石及黄疸。